根据现行GSP的规定，药品零售企业的质量管理人员应具有
A. 药学或相关专业的学历，或者具有药学专业的技术职称
B. 药学专业技术职称
C. 相应的药学专业技术职称
D. 药师以上专业技术职称
E. 主管药师以上专业技术职称

正确答案：A。药学或相关专业的学历，或者具有药学专业的技术职称

解析：本题考查药品零售企业经营和质量管理人员的资质要求。根据现行GSP的规定药品零售企业的质量管理人员应具有药学或者医学、生物、化学等相关专业学历或者具有药学专业技师职称（A对）。